肛裂“三联征”指
A. 肛裂，前哨痔和肛周脓肿
B. 肛裂，肛乳头肥大和肛周脓肿
C. 肛裂，前哨痔和肛乳头肥大
D. 肛裂，大便失禁和肛乳头肥大
E. 肛裂，前哨痔和大便失禁

正确答案：C。肛裂，前哨痔和肛乳头肥大

解析：慢性裂口上端的肛门瓣和肛乳头水肿，形成肥大乳头；下端皮肤因炎症、水肿及静脉、淋巴回流受阻，形成袋状皮垂向下突出于肛门外，称为前哨痔因肛裂、前哨痔、肛乳头肥大常同时存在（C对），故称为肛裂“三联症”，是肛裂的典型临床表现之一。